患者反复呕吐隔餐食物。查体：消痩，上腹部膨胀，并见胃型。应首先考虑的是
A. 肝炎
B. 肝硬化
C. 胃炎
D. 幽门梗阻
E. 胆囊炎

正确答案：D。幽门梗阻

解析：本例患者有反复呕吐宿食的病史，查体发现上腹部膨隆并可见胃型，诊断应首先考虑的是幽门梗阻（D对）。肝炎（A错）患者的主要临床表现为食欲减退、腹胀、部分患者可出现皮肤或巩膜黄染。肝硬化（B错）患者主要有肝功能减退如黄疸、出血和贫血以及门静脉高压如腹水、食管胃底静脉曲张两类临床表现。胃炎（C错）患者的主要临床表现为无规律性上腹痛，患者不会出现反复呕吐隔餐食物。胆囊炎（E错）患者的主要临床表现为阵发性右上腹绞痛，疼痛可放射至右肩、肩胛和背部，可有胆囊点压痛和墨菲氏征阳性。